对已确证患有乳腺癌的1000名妇女和未患乳腺癌的1000名妇女，用一乳腺癌筛选的试验检查，结果发现前者有900名为阳性结果，后者有100名为阳性结果。该试验的假阳性率是
A. 90%
B. 30%
C. 25%
D. 12%
E. 10%

正确答案：E。10%

解析：将题干数据整理如下：评价试验的整理表、筛检试验 金标准 合计、病例 非病例 、阳性 900（a） 100（b） 1000、阴性 100（c） 900（d） 1000、合计 1000 1000 2000。假阳性率是指金标准确诊的非病例中待评价试验错判为阳性者所占的百分比，假阳性率= b/（b+d）×100％=100/（100+900） ×100％=10％（E对）。